最常见的食物中毒是
A. 真菌性食物中毒
B. 化学性食物中毒
C. 有毒动植物食物中毒
D. 细菌性食物中毒
E. 原因不明的食物中毒

正确答案：D。细菌性食物中毒

解析：食物中毒是对食品安全影响最大的，其中细菌性食物中毒是最常见的食物中毒。掌握“食品安全”知识点。